女40岁，1周前唇周出现红斑，感觉灼痒，一天后出现成簇针尖大小水疱，一天后疱破糜烂后结痂，患病前有感冒史，拟诊
A. 口角炎
B. 盘状红斑狼疮
C. 唇疱疹
D. 扁平苔藓
E. 鹅口疮

正确答案：C。唇疱疹

解析：本题考查单纯疱疹-复发性疱疹性口炎。女40岁，1周前唇周出现红斑，感觉灼痒，一天后出现成簇针尖大小水疱，一天后疱破糜烂后结痂，患病前有感冒史，拟诊唇疱疹（C对）。1周前唇周出现红斑，感觉灼痒，一天后出现成簇针尖大小水疱，一天后疱破糜烂后结痂，患病前有感冒史，根据病变特点可诊断为复发性疱疹性口炎。口角炎（A错）有念珠菌口角炎和维生素缺乏症或细菌性口角炎，维生素B₂缺乏症同时并发舌炎、唇炎、阴囊炎或外阴炎，细菌性口角炎多单发于一侧口角，细菌培养阳性，且念珠菌性口角炎多发生于儿童和身体衰弱和血液病患者。盘状红斑狼疮（B错）是一种慢性皮肤-黏膜结缔组织疾病，病损特点为持久性红斑，中央萎缩凹下呈盘状；主要累及头面部皮肤及口腔黏膜，皮肤病损表面有黏着性鳞屑，黏膜病损周边有呈放射状排列的细短白纹。鹅口疮即急性假膜型念珠菌口炎，黏膜充血，有散在的色白如雪的柔软小斑点，不久融合为白色或蓝白色丝绒状斑片（E错）。扁平苔藓病损为小丘疹连成线状白色，大多左右对称，病损区黏膜正常、或发生充血、溃疡、糜烂、萎缩和水泡，病损消退后可留有色素，自觉粗糙、烧灼（D错）。